局部麻醉药中毒发生中枢兴奋或惊厥时应肌肉注射的药物是
A. 苯巴比妥钠
B. 硫喷妥钠
C. 琥珀酰胆碱
D. 维库溴铵
E. 阿曲库铵

正确答案：A。苯巴比妥钠

解析：巴比妥类药为术前用药催眠药，这类药有镇静、催眠、抗惊厥的作用。常用于预防局麻药的毒性反应，所以局部麻醉药中毒发生中枢兴奋或惊厥时应肌肉注射苯巴比妥钠（A对）。硫喷妥钠并发症有喉痉挛：用面罩加压吸氧，必要时行环甲膜穿刺吸氧，严重时可静注琥珀酰胆碱50～100mg后施行气管内插管（B错）。琥珀酰胆碱能与骨骼肌N2胆碱受体结合，产生去极化状态，使骨骼肌松弛。主要用于全麻手术时气管插管、骨折脱臼整复、破伤风等惊厥性疾病引起的肌肉痉挛（C错）。维库溴铵为麻醉药（骨骼肌松弛药），临床上主要与全麻药合用，适用于各种手术，也可用于全麻时气管内插管（D错）。阿曲库铵大剂量，尤其是快速给药，可诱发组胺释放而引起低血压、皮肤潮红、支气管痉挛（E错）。